美国PSI指数在200时，大气污染浓度水平为
A. 显著危害水平
B. 大气质量标准
C. 警戒水平
D. 警报水平
E. 紧急水平

正确答案：C。警戒水平